关于洛伐他汀性质和结构的说法，错误的是
A. 洛伐他汀是通过微生物发酵制得的HMG-CoA还原酶抑制剂
B. 洛伐他汀结构中含有内酯环
C. 洛伐他汀在体内水解后，生成的3，5-二羟基羧酸结构是药物活性必需结构
D. 洛伐他汀在临床上通常以钙盐的形式制成注射剂使用
E. 洛伐他汀具有多个手性中心

正确答案：D。洛伐他汀在临床上通常以钙盐的形式制成注射剂使用

解析：本题考查洛伐他汀。关于洛伐他汀性质和结构的说法，错误的是洛伐他汀在临床上通常以钙盐的形式制成注射剂使用（D错，为本题正确答案）。洛伐他汀是从红曲霉中提取的真菌代谢物，是第一个应用于临床的HMG-CoA还原酶抑制剂（A对）。洛伐他汀是前药，结构中含有内酯环（B对），需进入体内后分子中的羟基内酯结构水解为3，5-二羟基戊酸才表现出活性（C对）。其分子内含有8个手性中心（E对）。